创造性是科研工作者选题时应遵循的基本原则之一，其含义包括
A. 先进性
B. 新颖性
C. 独创性
D. 突破性
E. 以上都是

正确答案：E。以上都是

解析：本题考查创造性原则。创造性是科研工作者选题时应遵循的基本原则之一，其含义包括先进性、新颖性、独创性和突破性（E对ABCD错）。